1岁患儿，已诊断为“化脓性脑膜炎”，曾用青霉素加氯霉素治疗一周，病情好转，体温正常，近3天来又出现发热抽搐，查体：前囟紧张，脑脊液检查示：外观清亮，白细胞12×10⁹/L，蛋白450mg/L，氯化物110mmol/L，糖4.0mmol/L，应首先考虑的诊断是
A. 脑膜炎复发
B. 硬脑膜下积液（脓）
C. 脑水肿
D. 脑脓肿
E. 脑膜炎后遗症

正确答案：B。硬脑膜下积液（脓）

解析：硬脑膜下积液为化脓性脑膜炎常见并发症，主要发生在1岁以下婴儿。该患儿经化脓性脑膜炎有效治疗一般症状好转后又出现体温升高、意识障碍、惊厥、前囟隆起或颅压增高等症状。若硬膜下积液量＞2ml、蛋白质＞0.4g/L、RBC＜100×10⁶/L，即可确诊。结合题干应诊断为硬膜下积液（B对）。脑膜炎复发不会出现得如此迅速（A错）。脑水肿可出现落日眼，神经症状逐渐加重（C错）。脑脓肿大多继发于颅内感染（D错）。脑膜炎后遗症是急性脑膜炎治疗后留下手足震颤、反应迟钝、记忆力减退等病症（E错）。